被首选用于治疗肝阳上亢头痛的腧穴是
A. 风池、百会、悬颅、侠溪、行间
B. 风池、太冲、合谷、内关、后溪
C. 百会、通天、行间、阿是穴
D. 上星、头维、合谷、阿是穴
E. 率谷、太阳、侠溪、内庭

正确答案：A。风池、百会、悬颅、侠溪、行间

解析：肝阳上亢，上攻于头部，气血壅滞而致头痛，宜当选肝胆经相关腧穴及头部相关腧穴进行治疗。其中，风池为足少阳胆经腧穴，位于颈后区、枕骨之下，百会位于头部，前发际正中直上5寸，悬颅为足少阳胆经腧穴，位于头部，头维至曲鬓弧形连线的终点处；四穴合用可调和头部气血，通络止痛；侠溪为足少阳胆经之荥穴，行间为足厥阴肝经之荥穴，二穴可清泻肝胆之热（A对）。内关穴（B错）是手厥阴心包经腧穴，在前臂前区，腕掌侧远端横纹上3寸，掌长肌腱与桡侧腕屈肌腱之间；百会、通天、行间、阿是穴（C错）相配对肝阳上亢头痛也有一定治疗作用，但是只有行间是肝经腧穴，其平肝潜阳作用弱于A选项；合谷穴（D错）为大肠经腧穴，位于手背，第二掌骨桡侧中点处；内庭穴（E错）为足阳明胃经腧穴，位于足背第2、3趾间，趾蹼缘后方赤白肉际处。